补阴时适当配以补阳药称
A. 阴中求阳
B. 阳中求阴
C. 寒者热之
D. 扶阳抑阴
E. 补阴抑阳

正确答案：B。阳中求阴

解析：本题考查的是补其不足的含义和临床应用。补阴时适当配以补阳药称阳中求阴（B对）。对于阴阳偏衰，即阴液或阳气的一方虚损不足的病证，如阴虚、阳虚或阴阳两虚等，治当采用“补其不足”“虚者补之”之法。根据阴阳对立互制的理论，采用阴病治阳、阳病治阴冶法；根据阴阳互根互济的理论，采用阴中求阳、阳中求阴治法。1.阴病治阳：针对阳虚而阳不制阴，阴气偏亢的虚寒证，应采用助阳以抑阴（D错）的治法，又称为“益火之源，以消阴翳”。2.阳病治阴：针对阴虚而阴不制阳，阳气偏亢的虚热证，应采用滋阴以制阳（E错）的治法，又称为“壮水之主，以制阳光”。3.阴中求阳：在补阳时可适当配用补阴药的治法，使阳得阴助而生化无穷。4.阳中求阴（A错）：在补阴时可适当配用补阳药的治法，使阴得阳生而泉源不竭。对阴阳两虚证，则采用阴阳并补治法。但须分清主次而用，阳损及阴者，以阳虚为主，则应在补阳的基础上辅以滋阴之品；阴损及阳者，以阴虚为主，则应在滋阴的基础上辅以补阳之品。对于阴阳亡失的治疗，亡阳者，当回阳以固脱；亡阴者，当救阴以固脱。由于亡阳与亡阴二者均为极危重证候，皆与气脱病机密切相关，故治疗时都要施以峻剂补气固脱之法。寒者热之（C错）：寒者热之又称“以热治寒”，是指寒性病证出现寒象，用温热方药进行治疗。如表寒证用辛温解表方药，里寒证用辛热温里方药等。